毛细血管前括约肌舒缩受
A. 神经调节
B. 体液调节
C. 两者均有
D. 两者均无
E. 无

正确答案：B。体液调节

解析：微循环的舒缩活动及血液灌流主要由局部产生的舒血管物质进行反馈调节（即体液调节）（B对ACDE错），以保证毛细血管前括约肌节律性的收缩与舒张和毛细血管的交替开放，调节微循环的灌流量。